健康促进规划的3个组成部分是
A. 设计、管理、评价
B. 设计、评价、反馈
C. 评估、设计、实施
D. 评估、实施、管理
E. 设计、实施、评价

正确答案：E。设计、实施、评价